能随乳汁排出可能引起婴儿中毒的生产性毒物是
A. CS2
B. 有机氯
C. 铅
D. 以上都是
E. 以上都不是

正确答案：D。以上都是

解析：本题考查母乳中的生产性毒物。体内的铅主要经肾脏随尿排出，少部分铅可随粪便、唾液、汗液、乳汁、月经、脱落的皮屑等排出。乳汁内的铅可影响婴儿，血铅也可通过胎盘进入胎儿体内而影响到子代。CS₂可透过胎盘屏障。在CS₂接触女工胎儿脐带血中和乳母乳汁中可检测出CS₂。测定乳汁和脂肪组织可反映亲脂毒物（如有机氯农药等）的负荷，也可用于评价毒物是否能影响新生儿（E对ABCD错）。